经枕骨大孔入颅的动脉是
A. 脑膜中动脉
B. 颈内动脉
C. 椎动脉
D. 大脑中动脉
E. 眼动脉

正确答案：C。椎动脉

解析：椎动脉（C对）为经枕骨大孔入颅的动脉，其分支布于脑与脊髓。